中医学理论体系的哲学基础是
A. 精气学说
B. 阴阳学说
C. 五行学说
D. 阴阳五行学说
E. 精气阴阳五行学说

正确答案：E。精气阴阳五行学说

解析：中医学的基本特点：整体观念，辨证论治；中医学理论体系的哲学基础：精气，阴阳，五行学说（E对）；中医学的指导思想：整体观念。